男性，25岁，双下肢挤压伤，神志尚清楚，表情淡漠，口渴明显，面色苍白，皮肤湿冷，脉搏112次/分，血压12/9.33kPa（90/70mmHg），中心静脉压0.39kPa（4cmH2O）。毛细血管充盈迟缓。血pH值为7.32。病人处于何种情况
A. 未发生休克
B. 休克代偿期
C. 中度休克
D. 重度休克
E. 虚脱

正确答案：C。中度休克

解析：根据病人的综合临床表现，可以判断患者处于中度休克期。掌握“休克”知识点。